低酸性罐头典型的平酸菌为
A. 嗜热脂肪芽孢杆菌
B. 嗜热凝结芽孢杆菌
C. 地衣芽孢杆菌
D. 枯草芽孢杆菌
E. 蜡样芽孢杆菌

正确答案：A。嗜热脂肪芽孢杆菌